传染病的基本特征为
A. 有传染源、传播途径、免疫性
B. 有传染源、传染性、易感人群
C. 有病原体、有传染性、有流行病学特征、有感染后免疫
D. 有病原体、流行性、易感性
E. 有传染性、流行性、免疫性

正确答案：C。有病原体、有传染性、有流行病学特征、有感染后免疫

解析：传染病的基本特征：有病原体；有传染性；有流行病学特征（流行性、地方性、季节性）；有感染后免疫。掌握“传染病总论”知识点。